乳牙X线片中可观察到的内容是
A. 乳牙根尖周组织的病变状况和程度
B. 乳牙牙髓腔的钙变情况及根管的数目
C. 乳牙牙髓状态和活力
D. 恒牙牙胚发育状况及其三维位置
E. A、B、C、D都对

正确答案：A。乳牙根尖周组织的病变状况和程度

解析：本题考查乳牙X线片中可观察到的内容。乳牙X线检查对牙髓病和根尖周病的诊疗判断有重要意义。X线片可以观察到乳牙根尖周组织的病变状况和程度（A对）、乳牙牙髓腔的钙变情况及根管内有无内吸收等。对于多根牙，乳牙根管的数目（B错）由于投照角度不同，不能够全部显示。乳牙的牙髓状态和活力（C错）需进行温度测试等牙髓活力测验。但X线片有其局限性，只能显示其二维图像。可以显示恒牙牙胚发育状况及其三维位置（D错）的是CT。